“春夏养阳，秋冬养阴”的四时顺养原则理论源于
A. 《神龙本草》
B. 《礼记内则》
C. 《黄帝内经》
D. 《道德经》
E. 《伤寒论》

正确答案：C。《黄帝内经》

解析：《黄帝内经》应用阴阳学说来说明人体的形态结构、生理功能、病理变化、养生保健等；“春夏养阳，秋冬养阴”的四时顺养原则理论源于《黄帝内经》（C对）。《神农本草经》是我国第一部药物学专著，根据养生、治疗和有毒无毒，将药物分为上、中、下三品（A错）。《礼记·内则》：“春宜羔豚膳膏芗，夏宜腒鱐膳膏臊，秋宜犊麑膳膏腥，冬宜鲜羽膳膏膻（B错）”。《道德经》养生学可概括为：无为，虚静，至柔，和德（D错）。《伤寒论》中以天人相应的整体观作为养生学的基本出发点和指导思想（E错）。